女孩，2岁。发热3天。最高体温39℃，伴流涎、厌食、呕吐。查体：急性热病容，咽部充血，在咽腭弓的黏膜上可见多个2～4mm大小疱疹，有的破溃成小溃疡。该患儿最可能的诊断是
A. 咽结合膜热
B. 疱疹性口腔炎
C. 化脓性扁桃体炎
D. 流行性感冒
E. 疱疹性咽峡炎

正确答案：E。疱疹性咽峡炎

解析：女性幼童患者，发热3天。最高体温39℃，伴流涎、厌食、呕吐。查体：急性热病容，咽部充血，在咽腭弓的黏膜上可见多个2～4mm大小疱疹，有的破溃成小溃疡。综合患者的症状、体征和辅助检查，该患儿最可能的诊断是疱疹性咽峡炎（E对）。咽结合膜热（A错）的眼睛发红显著。疱疹性口腔炎（B错）为单纯疱疹病毒Ⅰ型感染所致，发病无明显季节差异。化脓性扁桃体炎（C错）可见扁桃体肿大。流行性感冒（D错）多无咽部疱疹的表现，可由病毒分离检查确诊。